患儿女，10个月。发热4天，体温波动在38.5～40℃，偶有咳嗽。昨晚和今晨均没有发热，中午发现躯干部有散在红色充血性斑丘疹，化验血WBC6.3×109/L，淋巴细胞63%，中性粒细胞37%，最可能的诊断是
A. 麻疹
B. 风疹
C. 幼儿急疹
D. 水痘
E. 猩红热

正确答案：C。幼儿急疹